细菌性痢疾抗菌治疗，应首选的药物是
A. 青霉素
B. 阿奇霉素
C. 氯霉素
D. 环丙沙星
E. 复方新诺明

正确答案：D。环丙沙星

解析：细菌性痢疾抗菌治疗，应首选的药物是喹诺酮类药物，环丙沙星属于喹诺酮类，故首选环丙沙星（D对）。青霉素（A错）、阿奇霉素（B错）可用于成人细菌性痢疾的治疗，但不作为首选。复方新诺明（E错）对大肠埃希菌感染的细菌性痢疾有一定效果，但不作为首选。氯霉素（D错）不用于细菌性痢疾的治疗，常用于伤寒、严重的厌氧菌感染等的治疗。